同样浓度和分散度的下列粉尘，何者致纤维化能力最强
A. 煤尘
B. 石英尘
C. 水泥尘
D. 滑石尘
E. 铅尘

正确答案：B。石英尘

解析：本题考查粉尘的致纤维化能力。肺尘埃沉着病（俗称尘肺）是由于在生产环境中长期吸入生产性粉尘而引起的以肺组织纤维化为主的疾病。粉尘致纤维化能力强弱取决于粉尘中二氧化硅的含量（B对ACDE错），石英中二氧化硅含量最高，达到99%。因此，石英尘在同样浓度和分散度下，它的致纤维化能力最强。